对动物内脏的化学组成叙述正确的是
A. 蛋白质含量较高
B. 胆固醇含量较高
C. 无机盐含量较少
D. 维生素含量较少
E. 碳水化合物含量较高

正确答案：B。胆固醇含量较高